厚朴除能除湿外，又能
A. 发汗
B. 解毒
C. 止呕
D. 劫痰
E. 平喘

正确答案：E。平喘

解析：本题考查的是厚朴的功效。厚朴除能除湿外，又能平喘（E对）。厚朴：【功效】燥湿，行气，消积，平喘。苍术：【功效】燥湿健脾，祛风湿，发汗（A错），明目。金钱草：【功效】利水通淋，除湿退黄，解毒（B错）消肿。广藿香：【功效】化湿，止呕（C错），发表解暑。砒石：【功效】外用蚀疮去腐；内服劫痰（D错）平喘，截疟。